通过使痰液中黏蛋白的二硫键断裂，降低痰液黏滞性的祛痰药物有
A. 磷酸苯丙哌林
B. 乙酰半胱氨酸
C. 羧甲司坦
D. 右美沙芬
E. 盐酸氨溴索

正确答案：B、C。乙酰半胱氨酸；羧甲司坦

解析：本题考查祛痰药乙酰半胱氨酸。乙酰半胱氨酸（B对）为黏痰溶解剂。本品中的巯基能使黏痰中黏蛋白肽链的二硫键断裂，变成小分子多肽，使痰液黏度降低；也能裂解脓性痰液中的DNA，使与DNA结合的蛋白失去保护，引起脓性痰液液液化而利于咳出。羧甲司坦（C对）为黏液调节剂，主要调节支气管腺体分泌，增加低黏度的唾液黏蛋白分泌，减少高黏度的岩藻黏蛋白产生，使痰液黏滞性降低，易于咳出；也能加强呼吸道纤毛运动，促进痰液排出。磷酸苯丙哌林（A错）是兼有外周及中枢作用的强效镇咳药。右美沙芬（D错）是中枢性镇咳药。盐酸氨溴索（E错）为黏痰溶解剂，主要通过减少和断裂黏液中的黏多糖纤维，降低痰液黏度，易于咳出。